使用毒性中药，每次处方剂量不得超过
A. 二日常用量
B. 二日极量
C. 三日常用量
D. 三日极量
E. 四日常用量

正确答案：B。二日极量